初孕妇，25岁。妊娠38周。骨盆外测量：骶耻外径18.5cm，髂嵴间径27cm，坐骨结节间径7.5cm。本例孕妇的骨盆应诊断为
A. 单纯扁平骨盆
B. 佝偻病性扁平骨盆
C. 均小骨盆
D. 漏斗型骨盆
E. 男型骨盆

正确答案：D。漏斗型骨盆

解析：青年初孕妇，骶耻外径18.5cm（正常值18～20cm），髂嵴间径27cm（正常值25～28cm），坐骨结节间径7.5cm（正常值8.5～9.5cm），说明其骨盆入口各径线值正常，坐骨结节间径缩短，该孕妇的可考虑为漏斗型骨盆（D对）。单纯扁平骨盆（P192）（A错）骨盆入口呈横扁圆形，骶岬向前下突出，使骨盆入口前后径缩短而横径正常。佝偻病性扁平骨盆（P192）（B错）骨盆入口呈横的肾形，骶岬向前突，耻骨弓角度增大，骨盆出口横径变宽。均小骨盆（P192-P193）（C错）是指骨盆外形属正常女型骨盆，但骨盆三个平面各径线均比正常值小2cm或更多。男型骨盆（P10）（E错）骨盆入口约成三角形，两侧壁内聚，坐骨棘突出，耻骨弓较窄，坐骨切迹窄呈高弓形，骶骨较直而前倾，致出口后矢状径较短，在女性极少见。